断肢再植成功率最高的上臂外伤种类是
A. 被机床压断的上臂
B. 被搅拌机绞断的上臂
C. 被火车辗压断的上臂
D. 被滚动皮带绞断的上臂
E. 被劫匪利刀砍断的上臂

正确答案：E。被劫匪利刀砍断的上臂

解析：断肢再植成功率与损伤性质有较大关系。锐器切割伤（E对）由于其断面整齐、污染轻、组织挫伤轻，再植成活率高；碾压伤（ABCD错），如机床、火车碾压、绞断伤等，受伤部位组织损伤严重，再植成活率不及切割伤；撕裂伤组织损伤广泛，再植成活率最低。